下列不属于团体行为干预方法的是
A. 应用竞争机制
B. 动员群众参与
C. 树立典型和培养骨干
D. 行为矫正技术
E. 开发领导

正确答案：D。行为矫正技术